根据《药品注册管理办法》，下列药品批准文号格式符合规定的是
A. 国卫药注字J20160008
B. 国药准字S20143005
C. 国食药准字Z20163026
D. 国食药监字H20130085

正确答案：B。国药准字S20143005

解析：本题考查的是的药品批准文号的格式。根据《药品注册管理办法》，下列药品批准文号格式符合规定的是国药准字S20143005（B对）。药品注册证书载明的药品批准文号的格式：①境内生产药品：国药准字H（Z、S）+四位年号+四位顺序号；②中国香港、澳门和台湾地区生产药品：国药准字H（Z、S）C+四位年号+四位顺序号；③境外生产药品：国药准字H（Z、S）J+四位年号+四位顺序号。其中，H代表化学药，Z代表中药，S代表生物制品。药品批准文号，不因上市后的注册事项的变更而改变。